在糖尿病的诊断中OGTT试验的2小时血糖水平应大于等于
A. 7.0mmol/L
B. 8.0mmol/L
C. 9.0mmol/L
D. 10.0mmol/L
E. 11.1mmol/L

正确答案：E。11.1mmol/L

解析：本题考查糖尿病的OGTT诊断试验。糖尿病是一组以慢性血葡萄糖（简称血糖）水平增高为特征的代谢性疾病，是由于机体胰岛素分泌缺陷和（或）胰岛素作用缺陷所引起。在OGTT诊断试验中，2小时血糖水平应大于等于11.1mmol/L（E对ABCD错）。